手术时应采用的对照组是
A. 阳性对照
B. 阴性对照
C. 空白对照
D. 安慰剂对照
E. 以上均错

正确答案：C。空白对照

解析：本题考查对照组的种类。手术时应采用的对照组是空白对照（C对）。对照组的种类有：1.空白对照：对照组不使用任何措施。临床试验一般不采用空白对照，因为它违反盲法原则。但在某些情况下，盲法试验无法进行，如手术等，此时使用安慰剂对照（D错）没有意义，这时可以使用空白对照。2.阳性对照（A错）：以标准方法或常规方法作为对照组，以新方法或需要研究的方法作为试验组。这种对照方法的效率较高，在新疗法或新药物的研究时，试验组和对照组的受试者都能得到治疗。3.阴性对照（B错）：对照组使用的方法除了试验组的研究因素外，其他部分均与试验组相同。如在研究含氟牙膏的防龋作用时，对照组所用的牙膏除了没有氟化物，其他成分都与试验组相同。4.其他：除以上这些对照方法以外，还有交叉对照、历史对照、潜在对照等方法。